支气管哮喘中起主要作用的Ig是
A. IgG
B. IgM
C. SIgA
D. IgE
E. IgD

正确答案：D。IgE